丁卡因的作用或应用为
A. 可用于浸润麻醉
B. 脂溶性弱
C. 穿透力弱
D. 作用较普鲁卡因弱
E. 可用于表面麻醉

正确答案：E。可用于表面麻醉

解析：丁卡因又称地卡因，化学结构与普鲁卡因相似，属于酯类局麻药，脂溶性强（B错）。其麻醉作用比普鲁卡因强10倍（D错），毒性大10～12倍，因其毒性大，一般不用于浸润麻醉（A错）。对黏膜的穿透力强（C错），常用于表面麻醉（E对）。